患者，6岁，左下后牙有洞疼痛4天，昨晚加重，不能入眠，最可能的诊断
A. 深龋嵌塞食物
B. 慢性牙髓炎
C. 慢性牙髓炎急性发作
D. 急性根尖周炎
E. 慢性根尖周炎急性发作

正确答案：C。慢性牙髓炎急性发作

解析：本题考查慢性牙髓炎急性发作的诊断。患者6岁，左下后牙有洞（龋坏）疼痛4天，昨晚加重（急性发作），不能入眠（牙髓炎），综合考虑应诊断为慢性牙髓炎急性发作（C对）。慢性牙髓炎是临床最常见的一型牙髓炎，龋源性的牙髓炎多数是慢性牙髓炎，出现急性症状时是慢性牙髓炎急性发作。深龋嵌塞食物（A错）、急性根尖周炎（D错）、慢性根尖周炎急性发作（E错）一般不会出现夜晚疼痛加重的表现。由于患者疼痛了4天，昨晚突然加重，是急性症状，不应只诊断为慢性牙髓炎（B错），是慢性牙髓炎急性发作。